下列关于胸膜腔的描述，不正确的是
A. 由壁、脏胸膜围成
B. 是封闭的腔隙
C. 腔内较大气压力低
D. 腔内有肺及少量浆液
E. 有左、右两腔，互不相通

正确答案：D。腔内有肺及少量浆液

解析：胸膜腔内仅有少量浆液（D错，为本题正确答案）。胸膜腔由壁、脏胸膜围成（A对）。胸膜腔是封闭的腔隙（B对）。胸膜腔腔内较大气压力低（C对）。胸膜腔有左、右两腔，互不相通（E对）。